根据《中国执业药师职业道德准则适用指导》，执业药师应当科学指导用药，确保药品质量，做到
A. 救死扶伤，不辱使命
B. 尊重患者，一视同仁
C. 依法执业，质量第一
D. 进德修业，珍视声誉
E. 尊重同仁，密切协作

正确答案：C。依法执业，质量第一

解析：本题考查的是执业药师的职业道德准则。根据《中国执业药师职业道德准则适用指导》，执业药师应当科学指导用药，确保药品质量，做到依法执业，质量第一（C对）。执业药师的职业道德准则：2006年10月18日，原中国执业药师协会发布了《中国执业药师职业道德准则》（简称《准则》)，2009年6月5日又对《准则》进行了修订。同时，为了指导全国广大执业药师更好地贯彻、实施《准则》，规范执业药师的执业行为，原中国执业药师协会又在《准则》的基础上，于2007年3月13日发布了《中国执业药师职业道德准则适用指导》，并在2009年6月5日进行了修订。《准则》包含五条职业道德准则，适用于中国境内的执业药师，包括依法履行执业药师职责的其他药学技术人员。执业药师在执业过程中应当接受各级药品监督管理部门、执业药师协会和社会公众的监督。具体内容如下：1.救死扶伤，不辱使命（A错）：执业药师应当将患者及公众的身体健康和生命安全放在首位，以专业知识、技能和良知，尽心、尽职、尽责为患者及公众提供药品和药学服务。2.尊重患者，平等相待：执业药师应当尊重患者或消费者的价值观、知情权、自主权、隐私权，对待患者或消费者应不分年龄、性别、民族、信仰、职业、地位、贫富，一视同仁（B错）。3.依法执业，质量第一：执业药师应当遵守药品管理法律、法规，恪守职业道德，依法独立执业，确保药品质量和药学服务质量，科学指导用药，保证公众用药安全、有效、经济、适当。4.进德修业，珍视声誉（D错）：执业药师应当不断学习新知识、新技术，加强道德修养，提高专业水平和执业能力；知荣明耻，正直清廉，自觉抵制不道德行为和违法行为，努力维护职业声誉。5.尊重同仁，密切协作（E错）：执业药师应当与同仁和医护人员相互理解，相互信任，以诚相待，密切配合，建立和谐的工作关系，共同为药学事业的发展和人类的健康奉献力量。。